后面有纵行浅沟的是
A. 前列腺囊
B. 前列腺小囊
C. 前列腺底
D. 前列腺尖
E. 前列腺体

正确答案：E。前列腺体

解析：前列腺体（E对）后面平坦，中间有一纵行浅沟称为前列腺沟。